女，16岁。心慌，多汗，手颤2个月。无明显突眼，甲状腺I°弥漫性肿大。血游离T₃、T₄增高，TSH降低。肝肾功能正常，血WBC6.8×10⁹/L。诊为甲亢。既往无甲亢病史。治疗选择
A. 核素¹³¹I治疗
B. 甲状腺部分切除术
C. 抗甲状腺药物治疗
D. 抗甲状腺药物治疗后手术治疗
E. 抗甲状腺药物治疗后核素¹³¹I治疗

正确答案：C。抗甲状腺药物治疗

解析：青春期女性患者，诊断为甲亢，无明显突眼，甲状腺I°弥漫性肿大（抗甲状腺药物治疗适应证），既往无甲亢病史。肝肾功能正常，血WBC6.8×10⁹/L[正常范围为（4～10）×10⁹/L]，无药物治疗禁忌，治疗首选抗甲状腺药物治疗（C对）。本例为16岁初治甲亢患者，甲状腺切除手术及¹³¹I放射治疗（ABDE错）会造成永久性甲状腺功能减退，影响其生长发育。